2010年全球口腔健康目标中35～44岁的无牙颌率为
A. 不超过2%
B. 不超过4%
C. 不超过8%
D. 不超过10%
E. 不超过12%

正确答案：A。不超过2%

解析：本题考查口腔健康状况指标。2010年全球口腔健康目标中35～44岁的无牙颌率为不超过2%（A对）。口腔健康状况指标：①5～6岁：90%无龋；②12岁：龋均（DMFT）不超过1；③15岁：至少有5个牙周健康区段，其余CPI记分为1或2；④18岁：无因龋病或牙周病而缺失之牙；⑤35～44岁：无牙颌不超过2%，90%至少保持20颗功能牙，CPI记分为4，不超过0.1个区段；⑥65～74岁：无牙颌不超过5%，75%至少保持20颗功能牙，CPI记分为4，不超过0.5个区段。